损伤后其症状出现于病灶侧
A. 皮质核束
B. 三叉神经脊束
C. 三叉丘系
D. 内侧丘系
E. 脊髓丘系

正确答案：B。三叉神经脊束

解析：参与头面部的痛温觉和触压觉传导通路若三叉丘脑束以上受损，则导致对侧头面部痛温觉和触压觉障碍（D错）；若三叉丘脑束以下受损，即三叉神经脊束核（B对）和三叉神经脑桥核受损，则同侧头面部痛温觉和触压觉发生障碍。